梅毒是
A. 代谢疾病
B. 内分泌疾病
C. 过敏性疾病
D. 免疫缺陷病
E. 传染性疾病

正确答案：E。传染性疾病

解析：本题考查梅毒。梅毒是传染性疾病（E对）。梅毒是一种慢性性传播疾病，梅毒患者是梅毒的唯一传染源。后天梅毒约95%以上通过性接触传染，先天梅毒通过胎盘传染。少数患者可因接触带有梅毒螺旋体的内衣、被褥、毛巾、剃刀、文具、医疗器械以及哺乳、输血而间接被感染。